多含裂环烯醚萜苷类成分的是
A. 茄科
B. 蓼科
C. 玄参科
D. 芸香科
E. 龙胆科

正确答案：E。龙胆科

解析：本题考查的是含裂环烯醚萜苷的中药。多含裂环烯醚萜苷类成分的是龙胆科（E对）。裂环环烯醚萜苷在龙胆科、睡菜科、茜草科、忍冬科、木犀科等植物中分布较广，在龙胆科的龙胆属及獐牙菜属分布更为普遍。如龙胆中的龙胆苦苷，獐牙菜中的獐牙菜苷及獐牙菜苦苷等。茄科（A错）植物大多含有生物碱。生物碱类主要分布于植物界，在动物界中少有发现。生物碱绝大多数存在于双子叶植物中，已知有50多个科的120多个属中存在生物碱。与中药有关的典型的科有毛茛科（黄连属黄连，乌头属乌头、附子）、防己科（汉防己、北豆根）、罂粟科（罂粟、延胡索）、茄科（曼陀罗属洋金花、颠茄属颠茄、莨菪属莨菪）、马钱科（马钱子）、小檗科（三颗针）、豆科（苦参属苦参、槐属苦豆子）等。单子叶植物也有少数科属存在生物碱，如石蒜科、百合科（贝母属的川贝母、浙贝母）、兰科等。少数裸子植物如麻黄科、红豆杉科、三尖杉科和松柏科也存在生物碱。低等植物中仅发现极个别的存在生物碱，如烟碱存在于蕨类植物中，麦角生物碱存在于菌类植物中。地衣、苔藓类植物中仅发现少数简单的吲哚类生物碱。藻类、水生类植物中未发现生物碱。蓼科（B错）植物如大黄、虎杖、何首乌主要含蒽醌类成分。玄参科（C错）植物多强心苷。强心苷主要分布于夹竹桃科、玄参科、百合科、萝藦科、十字花科、毛茛科和桑科等。动物中至今尚未发现强心苷成分，中药蟾酥是一类具有强心作用的甾体化合物，但不属于苷类，属于蟾毒配基的脂肪酸酯类。芸香科（D错）植物多含挥发油。挥发油在植物来源的中药中分布非常广泛，特别是菊科、芸香科、伞形科、唇形科、樟科、木兰科、马兜铃科、败酱科、姜科、胡椒科、桃金娘科、马鞭草科等植物中都富含挥发油。此外，松科、柏科、杜鹃花科、木犀科、瑞香科、檀香科、蔷薇科等的某些植物中也含丰富的挥发油。